不属于甲状颈干的分支的是
A. 甲状腺下动脉
B. 肩胛上动脉
C. 颈升动脉
D. 颈横动脉
E. 肩胛下动脉

正确答案：E。肩胛下动脉

解析：甲状腺下动脉（A对）、肩胛上动脉（B对）、颈升动脉（C对）、颈横动脉（D对）均为甲状颈干的分支。肩胛下动脉（E错，为本题正确答案）不属于甲状颈干的分支。